青年男性，直肠触及2cm的肿物，光滑。指诊带血。判断是哪种疾病
A. 直肠息肉
B. 直肠癌
C. 直肠脱垂
D. 血栓性外痔
E. 肛瘘

正确答案：A。直肠息肉

解析：青年男性，直肠触及2cm的肿物，指诊带血，肿物光滑质软，判断为直肠息肉（A对）；直肠癌（B错），在直肠指检可触及高低不平的肿块；直肠脱垂（C错），直肠黏膜可脱出，便后需用手托回肛门内；血栓性外痔（D错），表现为肛周暗紫色卵圆形肿物，表面皮肤水肿、质硬、急性期触痛压痛明显；肛瘘（E错），肛诊检查触及到黏膜外条索状肿物，质硬、固定。